急性阑尾炎属
A. 蜂窝织炎
B. 脓肿
C. 卡他性炎
D. 纤维素性炎
E. 积脓

正确答案：A。蜂窝织炎

解析：急性阑尾炎是外科常见的急腹症，镜下可见大量中性粒细胞弥漫浸润，并有炎性水肿及纤维素渗出，属于蜂窝织炎（A对）。脓肿（P76）（B错）指器官或组织内的局限性化脓性炎症，其主要特征是组织发生溶解坏死，形成充满脓液的腔，即脓腔。卡他性炎（P75）（C错）指发生在黏膜的浆液性炎，如感冒初期，鼻黏膜排出大量浆液性分泌物。纤维素性炎（P75）（D错）指以纤维蛋白原渗出为主的急性炎症，常见于大叶性肺炎等。积脓（P76）（E错）指化脓性炎发生于浆膜、胆囊和输卵管时，脓液在浆膜腔、胆囊和输卵管腔内积存。